女50岁，患风湿性心脏病6年，用洋地黄毒苷和利尿药维持治疗。晨起突感呼吸困难、心悸。查体：端坐呼吸，呼吸浅快，咳大量泡沫样痰。心率125次/分，双肺满布湿啰音，诊断为急性左心衰竭，应给予何种药物治疗
A. 阿托品
B. 安定
C. 肾上腺素
D. 吗啡
E. 东莨菪碱

正确答案：D。吗啡